DNA复制时，以序列5'-TAGA-3'为模板合成的互补结构是
A. 5'-TCTA-3'
B. 5'-TAGA-3'
C. 5'-ATCT-3'
D. 5'-AUCU-3'
E. 5'-UCUA-3'

正确答案：A。5'-TCTA-3'